男，50岁，急性心肌梗死患者。突然出现胸闷、气喘、大汗淋滴，两肺满布干湿啰音，第一心音低钝。最可能的诊断是
A. 急性左心衰
B. 急性心包炎
C. 急性动脉栓塞
D. 主动脉夹层
E. 急性肺栓塞

正确答案：A。急性左心衰

解析：患者中年男性，有急性心肌梗死（急性左心衰的常见病因）病史，突然出现胸闷、气喘、大汗淋滴，两肺满布干湿啰音，第一心音低钝（急性左心衰的常见临床表现和体征），本例患者最可能的诊断是急性左心衰（A对）。急性心包炎（P302）（B错）多有上呼吸道感染的病史，表现为胸痛和心包摩擦音。急性动脉栓塞（C错）的典型表现为“5P”征，即疼痛（pain）、麻木（parasthesia）、运动障碍（paralysis）、无脉（pulselessness）和苍白（pallor）。主动脉夹层（P324）（D错）引多表现为突发的持续的刀割样剧痛，两上肢或上下肢血压相差较大，很少出现肺循环淤血症状。急性肺栓塞（E错）的典型三联征为呼吸困难、胸痛、咯血。